以下能导致超敏反应的是
A. 变应原
B. 超抗原
C. 耐受原
D. 抗原
E. 抗体

正确答案：A。变应原

解析：变应原是指能诱导机体产生IgE，引起Ⅰ型超敏反应的抗原物质，可为蛋白质和与蛋白质结合的小分子半抗原物质（A对）。超抗原（B错）是指一类只需极低浓度即可激活大量的T细胞活化，产生极强免疫应答的物质。耐受原（C错）是机体免疫系统接触某种抗原后所产生的对该抗原的特异性无应答状态。抗原（D错）是指所有能激活和诱导免疫应答的物质，通常指能被T、B淋巴细胞表面特异性抗原受体（TCR或BCR）识别及结合，激活T、B细胞增殖、分化、产生免疫应答效应产物（特异性淋巴细胞或抗体），并与效应产物结合，进而发挥适应性免疫应答效应的物质。抗体（E错）抗体是介导体液免疫的重要效应分子，是免疫系统在抗原刺激下，由B细胞或记忆B细胞增殖分化成的浆细胞所产生的、可与相应抗原发生特异性结合的免疫球蛋白。